属于噻唑烷二酮类（TZDs）胰岛素增敏剂的药物是
A. 西格列汀
B. 那格列奈
C. 格列美脲
D. 利拉鲁肽
E. 罗格列酮

正确答案：E。罗格列酮

解析：本题考查降糖药。属于噻唑烷二酮类（TZDs）胰岛素增敏剂的药物是罗格列酮（E对）。罗格列酮通过增加骨骼肌、肝脏、脂肪组织对胰岛素的敏感性，提高细胞对葡萄糖的利用而发挥降低血糖的疗效。口服降糖药的分类：（1）磺酰脲类促胰岛素分泌药：有格列本脲、格列吡嗪、格列美脲（C错）等。（2）非磺酰脲类促胰岛分泌药：瑞格列奈、那格列奈（B错）。（3）双胍类药：二甲双胍。（4）α-葡萄糖苷酶抑制剂：阿卡波糖。（5）胰岛素增敏剂：罗格列酮。（6）胰高糖素样肽-1（GLP-1）受体激动剂：利拉鲁肽（D错）。（7）二肽基肽酶-4（DPP-4）抑制剂：西格列汀（A错）。